不属于冠心病主要危险因素的是
A. 吸烟
B. 高血压
C. 酗酒
D. 年龄
E. 高胆固醇血症

正确答案：C。酗酒

解析：饮酒量与血压水平线性相关，尤其与收缩压相关性更强（P248）。故酗酒（C错，为本题正确答案）属于高血压的危险因素，而并非冠心病。冠心病主要危险因素包括年龄（D对）、性别、血脂异常、高血压（B对）、吸烟（A对）、高血压糖尿病和糖耐量异常、肥胖、家族史等。其中脂质代谢异常是动脉粥样硬化最重要的危险因素。临床资料表明，动脉粥样硬化常见于高胆固醇血症（E对）。